患者发热恶热，口渴喜饮，汗多，小便短黄，气短，神疲，肢体困倦，舌红苔黄，脉虚数，其临床意义是
A. 风淫证
B. 燥淫证
C. 火淫证
D. 暑淫证
E. 湿淫证

正确答案：D。暑淫证

解析：由于暑性炎热，蒸腾津液，故见发热恶热，汗多；暑邪耗气伤津，故见口渴喜饮气短神疲，小便短黄；暑夹湿邪，阻碍气机，故见肢体困倦，苔黄，故辨证为暑淫证（D对）。风淫证表现为恶风，微发热，汗出，苔薄白，脉浮缓；或有鼻塞、流清涕、喷嚏，或伴咽喉痒痛、咳嗽（A错）。燥淫证表现为口唇、鼻腔、咽喉干燥，皮肤干燥甚至皲裂、脱屑，口渴欲饮，舌苔干燥，大便干燥，小便短黄，或见干咳少痰，痰黏难咯等（B错）。火淫证表现为发热微恶寒，头痛，咽喉疼痛，鼻塞流浊涕，舌边尖红，苔菏黄，脉浮数（C错）。湿淫证表现为头重如裹，肢体困重，倦怠嗜睡，或伴恶寒发热，或肢体关节、肌肉酸痛，或为局部渗涌湿液，或皮肤湿疹、痛痒（E错）。